患者，女，70岁，BMI21kg/m²，45岁时绝经，10年前开始，经常出现腰背部疼痛，活动后加重，但未就诊，平日外出活动较少，近5年身高降低，驼背明显。10天前患者不慎摔倒，右上肢活动受限、疼痛，就诊后检查结果：血钙1.97mmol/L，血磷1.39mmol/L；右上肢X光检查提示：右桡骨远端骨折。骨密度检查结果：T值为-2.9。入院诊断：右桡骨远端骨折，老年性骨质疏松症。患者服用阿仑膦酸钠3个月后复查，主诉反酸、咽喉烧灼感明显，为此，用药方案更换为唑来膦酸5mg，每年静脉滴注1次，首次静脉滴注唑来膦酸后，出现发热和肌肉酸痛，建议对症治疗的药物是
A. 地塞米松
B. 双醋瑞因
C. 对乙酰氨基酚
D. 秋水仙碱
E. 吗啡

正确答案：C。对乙酰氨基酚

解析：本题考查唑来膦酸。首次静脉滴注唑来膦酸后，出现发热和肌肉酸痛，建议对症治疗的药物是对乙酰氨基酚（C对）。地塞米松（A错）主要治疗急、慢性肾上腺皮质功能衰退；自身免疫性疾病，如风湿热、风湿性心肌炎、类风湿关节炎；各种原因引起的休克；过敏性疾病，如荨麻疹、枯草热、过敏性鼻炎、支气管哮喘。双醋瑞因（B错）用于治疗退行性关节疾病（骨关节炎及相关疾病）。秋水仙碱（D错）用于治疗痛风性关节炎的急性发作，预防复发性痛风性关节炎的急性发作。吗啡（E错）除癌性剧痛可长期应用外，一般只限于短期用于其它镇痛药无效的急性锐痛，如严重创伤、烧伤等剧痛。